男性，40岁。中上腹饥饿性隐痛反复发作10年，伴反酸嗳气，进食和服用抑酸剂可缓解。为确诊应选择的检查手段是
A. 血清淀粉酶测定
B. 癌胚抗原测定
C. 胃镜检查
D. 腹部X线平片
E. 中腹部B超

正确答案：C。胃镜检查

解析：中青年男性患者，反复发作饥饿性上腹痛（饥饿痛为十二指肠溃疡的特征性表现）10年，服用抗酸剂可缓解，可诊断为消化性溃疡（十二指肠溃疡），为确诊应选择的检查手段是胃镜检查（C对），其为十二指肠溃疡的重要检查手段，不仅可作出十二指肠溃疡的诊断，亦可诊断其他疾病。血清淀粉酶测定（A错）用于诊断急性胰腺炎（P431）。癌胚抗原测定（B错）用于肿瘤的筛查及肿瘤治疗效果的评定。腹部X线平片（D错）主要用于十二指肠穿孔诊断，可见隔下游离气体。中腹部B超（E错）主要用于腹部实质脏器损伤及腹腔积液的诊断。